水中大肠菌群指标是指
A. 发现一个大肠菌群的最小水量
B. 发现一个大肠菌群的最大水量
C. 发现大肠菌群的最小需水量
D. 1L水中大肠菌群的个数
E. 1ml水中大肠菌群的个数

正确答案：D。1L水中大肠菌群的个数

解析：本题考查水中大肠菌群指标。水中大肠菌群指标是指1L水中大肠菌群的个数（D对ABCE错），它是用来衡量水质的一个重要指标，可以反映水体中的大肠菌群的数量，从而反映水体的污染程度。大肠菌群的数量越多，说明水体污染程度越高，水质越差。